视网膜的视部贴附于
A. 睫状体的外面
B. 睫状体的内面
C. 脉络膜的内面
D. 脉络膜的外面
E. 虹膜的内面

正确答案：C。脉络膜的内面

解析：视网膜的视部即视网膜的脉络膜部，贴附于脉络膜的内面（C对）；贴附于虹膜内面（E错）的是视网膜的虹膜部和贴附于睫状体内面（B错）的是视网膜的睫状体部，两者合称为视网膜盲部。